狗脊的
A. 断面有淡黄色小点排成数轮同心环
B. 断面具放射状纹理
C. 断面有“星点”
D. 断面有一条凸起的环纹或条纹
E. 断面有“云锦状花纹”

正确答案：D。断面有一条凸起的环纹或条纹

解析：本题考查的是狗脊药材的性状鉴别。狗脊的断面有一条凸起的环纹或条纹（D对）。狗脊：【性状鉴别】药材生狗脊片呈不规则长条形或圆形；切面浅棕色，较平滑，近边缘处有1条棕黄色隆起的木质部环纹或条纹，边缘不整齐。偶有金黄色绒毛残留；质脆，易折断，有粉性。断面有淡黄色小点排成数轮同心环（A错）的药材是川牛膝。川牛膝：【性状鉴别】药材呈近圆柱形，微扭曲，向下略细或有少数分枝。表面黄棕色或灰褐色，具纵皱纹、支根痕和多数横长的皮孔样突起。质韧，不易折断，断面浅黄色或棕黄色，异型维管束点状，排列成数轮同心环。气微，味甜。断面具放射状纹理（B错）的药材是甘草。甘草：【性状鉴别】药材根呈圆柱形。外皮松紧不一，红棕色、暗棕色或灰褐色，有显著的纵皱纹、沟纹、皮孔及稀疏的细根痕。质坚实而重，断面略显纤维性，黄白色，粉性，形成层环明显，射线放射状，有的有裂隙，显“菊花心”。根茎呈圆柱形，表面有芽痕，横切面中央有髓。气微，味甜而特殊。断面有“星点”（C错）有的药材是大黄。大黄：【性状鉴别】药材呈类圆柱形、圆锥形、卵圆形或不规则块片状。除尽外皮者表面黄棕色至红棕色，有的可见类白色网状纹理及“星点”（异型维管束）散在，残留的外皮棕褐色，多具绳孔及粗皱纹。质坚实，有的中心稍松软，断面淡红棕色或黄棕色，显颗粒性；根茎髓部宽广，有“星点”环列或散在；根木部发达，具放射状纹理，形成层环明显，无“星点”。气清香，味苦而微涩，嚼之粘牙，有沙粒感。断面有“云锦状花纹”（E错）的药材是何首乌。何首乌：【性状鉴别】药材呈团块状或不规则纺锤形。表面红棕色或红褐色，皱缩不平，有浅沟，并有横长皮孔样突起及细根痕。体重，质坚实，不易折断，切断面浅黄棕色或浅红棕色，显粉性，皮部有4～11个类圆形异型维管束环列，形成云锦状花纹，中央木部较大，有的呈木心。气微，味微苦而甘涩。